9个月的男婴，36周早产，生产时有窒息史。现会抬头，但坐不稳，不会站，能听懂名字，但不会叫“爸"“妈”。请选择合适的智力发育诊断性评价量表
A. 丹佛发育量表（DDST）
B. 绘人试验
C. 贝利婴儿发育量表
D. 韦氏学前儿童智力量表（WPP-SI）
E. 韦氏儿童智力量表（WISC）

正确答案：C。贝利婴儿发育量表

解析：本题考查贝利婴儿发育量表的相关内容。贝利婴儿发育量表（C对）适合1月龄～3.5岁的婴幼儿心理发育水平的检查，确定发育迟缓程度以及干预后的效果，也用于研究儿童神经心理发育。丹佛发育量表（A错）适合2月龄～6岁的儿童智能发育水平的监测，可作为高危儿童发育筛查工具。绘人试验（B错）适用于5岁以上儿童比较通用的智力测验方法。韦氏学前儿童智力量表（D错）适用于2岁6个月～7岁3月幼儿的智力测量工具。韦氏儿童智力量表（E错）评估6岁至16岁儿童智力水平的智力测验工具。